下列不属于体质的特点的是
A. 先天遗传性
B. 差异多样性
C. 动态可变性
D. 群类趋异性
E. 相对稳定性

正确答案：D。群类趋异性

解析：根据先后天因素，体质具有以下特点：1.先天遗传性（A对）；2.差异多样性（B对）；3.形神一体性；4.群类趋同性（D错，为本题正确答案）；5.相对稳定性（E对）；6.动态可变性（C对）；7.连续可测性；8.后天可调性。